在补阴时适当配以补阳药称为
A. 阴中求阳
B. 阳中求阴
C. 阴病治阳
D. 阳病治阴
E. 阴阳双补

正确答案：B。阳中求阴

解析：根据阴阳互根的理论，临床上治疗阴虚证时，在滋阴剂中适当佐以补阳药，即所谓“阳中求阴”。治疗阳虚证时，在助阳剂中，适当佐以滋阴药，即谓“阴中求阳”。因阳得阴助而生化无穷，阴得阳升而泉源不竭。据阴阳互根的原理，补阳时适当佐以补阴药谓之阴中求阳；补阴时适当配以补阳药谓之阳中求阴。所以（B对）。其意是使阴阳互生互济，不但能增强疗效，同时亦能限制纯补阳或纯补阴时药物的偏性及副作用。